患者，女，47岁，出现一侧面部骤然发作性闪痛，诊断为三叉神经痛，应选用的药物是
A. 山莨菪碱
B. 布洛芬
C. 麦角胺咖啡因
D. 卡马西平
E. 吗啡

正确答案：D。卡马西平

解析：本题考查治疗三叉神经痛的药物。卡马西平（D对）是三叉神经痛首选药，如无效可继服苯妥英钠或氯硝西泮等药物。山莨菪碱（A错）、颠茄浸膏片用于痉挛性疼痛。布洛芬（B错）、阿司匹林、对乙酰氨基酚均通过对环氧酶的抑制而减少前列腺素的合成，由此减轻组织充血、肿胀，降低神经痛觉的敏感性，对痛经等有较好的效果。麦角胺咖啡因（C错）用于反复性偏头痛。吗啡（E错）用于其他镇痛药无效的急性锐痛，如严重创伤、战伤、烧伤、晚期癌症等疼痛。